血栓尾部的主要成分是
A. 纤维蛋白及血小板
B. 血小板及粒细胞
C. 纤维蛋白及淋巴细胞
D. 纤维蛋白及粒细胞
E. 纤维蛋白及红细胞

正确答案：E。纤维蛋白及红细胞

解析：血栓尾部的主要成分是红色血栓， 镜下主要由纤维蛋白及红细胞（E对）组成。纤维蛋白及血小板（A错）为白色血栓的主要成分，主要位于血栓的头部（P53）。